胃癌病位在胃，与哪些脏腑关系密切
A. 肝、脾、肾
B. 肝、心、肾
C. 脾、肺、肾
D. 心、肺、肾
E. 心、脾、肾

正确答案：A。肝、脾、肾

解析：由于忧思伤脾，或脾肾阳虚，聚湿成痰，或郁怒伤肝，日久气郁结，气滞血瘀，则痰瘀互结而致病，故胃癌的发生主要与肝、脾、肾（A对）的关系密切（BCDE错）。